白豆蔻温中止呕，又能
A. 疏肝行气
B. 化湿行气
C. 活血行气
D. 燥湿行气
E. 健脾行气

正确答案：B。化湿行气

解析：本题考查的是白豆蔻的功效。白豆蔻温中止呕，又能化湿行气（B对）。白豆蔻：【功效】化湿行气，温中止呕。月季花：【功效】活血调经，疏肝解郁。月季花既活血化瘀，又疏肝行气（AC错）。草豆蔻：【功效】燥湿行气（D错），温中止呕。木香：【功效】行气止痛，健脾（E错）消食。